男，10岁。其母有哮喘史，患儿幼时对花粉过敏，反复发作喘息数次以上，昨又突发喘息。查两肺满布哮鸣音，皮下注射肾上腺素后，哮鸣音明显减少。对该患儿有效的紧急处理是
A. 美托洛尔
B. 苯巴比妥注射
C. 西地兰注射
D. 氢化可的松注射
E. 注射甘露醇

正确答案：D。氢化可的松注射

解析：患儿有哮喘家族史，有花粉过敏史，提示患儿为过敏体质。突发喘息，两肺部满哮鸣音，注射肾上腺素后明显缓解提示喘息为哮喘发作。哮喘患者急性发作期首选糖皮质激素静脉注射（D对）。